决定血氧饱和度最重要的指标是
A. CO2分压
B. 血液温度
C. 血液pH值
D. 血氧分压
E. 红细胞内2，3-DPG浓度

正确答案：D。血氧分压

解析：血红蛋白氧饱和度（S02）简称血氧饱和度，是指血液中氧合Hb占总Hb的百分数，约等于血氧含量与血氧容量的比值。虽然血氧饱和度与血液pH值（C错）、血液温度（B错）、CO2分压（A错）以及红细胞内2,3-DPG浓度（E错）有关，但主要取决于血氧分压，故血氧分压（D对）是决定血氧饱和度最重要的指标。